一般情况下，收缩压的高低主要反映
A. 心脏每搏输出量
B. 外周阻力
C. 心率
D. 主动脉管壁弹性
E. 循环血量

正确答案：A。心脏每搏输出量